女，28岁，G2P1。停经2月余，阴道少量流血10天。妇科检查：宫体如4个月妊娠大小。B超显示宫腔内充满落雪状光点，未测到胎体和胎盘回声，双附件区探及直径5cm大小无回声包块。初步诊断是
A. 双侧卵巢肿瘤
B. 稽留流产
C. 羊水过多
D. 葡萄胎
E. 绒癌

正确答案：D。葡萄胎

解析：育龄期女性，G2P1，停经2月余，阴道少量流血10天，妇科检查：宫体如4个月妊娠大小（提示子宫大于妊娠月份），B超显示宫腔内充满落雪状光点（葡萄胎的典型超声图像），未测到胎体和胎盘回声，双附件区探及直径5cm大小无回声包块（提示双侧卵巢囊肿），根据患者的症状、体征及B超检查结果，考虑最可能的诊断为葡萄胎（D对），该病的主要症状为停经后阴道不规则流血。该患者双侧卵巢囊肿，并不是双侧卵巢肿瘤（A错）。 稽留流产（B错）指胚胎或胎儿已死亡滞留宫腔内未能及时自然排出者，子宫较停经周数小，质地不软，未闻及胎心。羊水过多（C错）者存在妊娠囊及胎心搏动。绒癌（E错）超声的表现为肌层的高回声团块，该患者的病灶只存在于宫腔中。